可用于制备不溶性骨架片的是
A. 羟丙基甲基纤维素
B. 单硬脂酸甘油酯
C. 大豆磷脂
D. 无毒聚氯乙烯
E. 乙基纤维素

正确答案：D、E。无毒聚氯乙烯；乙基纤维素

解析：本题考查制备不溶性骨架片的材料。不溶性骨架材料是指不溶于水或水溶性极小的高分子聚合物或无毒塑料等。常用的有乙基纤维素（EC）（E对）、聚乙烯、无毒聚氯乙烯（D对）、乙烯-醋酸乙烯共聚物、硅橡胶等。羟丙甲纤维素（HPMC）（A错）为亲水凝胶骨架材料。单硬脂酸甘油酯（B错）为生物溶蚀性骨架材料。大豆磷脂（C错）可用作脂质体双分子层基本材料，而不能用作缓释片材料。